男，16岁。阵发性心悸1年余，突发突止，发作间歇心电图正常，10分钟前再次发作，心电图示快速、规则的QRS波群，形态正常，未见明显P波。急诊医师在患者右胸锁乳突肌内缘平甲状软骨水平按摩数秒钟后，心律突然恢复正常。该治疗手法的作用机制是
A. 减弱心迷走神经紧张
B. 加强心迷走神经冲动
C. 加强心交感神经冲动
D. 兴奋主动脉弓压力感受器
E. 兴奋颈动脉体

正确答案：B。加强心迷走神经冲动

解析：患者男，16岁，阵发性心悸1年余，突发突止发作期间心电图正常，10分钟前再次发作，心电图示快速、规则的QRS波群，形态正常，未见明显P波，考虑阵发性室上性心动过速急性发作期，心功能、血压正常时可通过颈动脉窦按摩法刺激迷走神经。加强迷走神经兴奋（B对），对心脏产生负性变时、变力、变传导作用，终止发作。